引起血源性肺脓肿最常见的病原菌是
A. 粪链球菌
B. 葡萄球菌
C. 大肠埃希菌
D. 肺炎克雷伯杆菌
E. 厌氧菌

正确答案：B。葡萄球菌

解析：血源性肺脓肿多是由于皮肤外伤感染、疖、痈、中耳炎或骨髓炎导致的脓毒症，菌栓经血行播散到肺，引起小血管栓塞、炎症和坏死而致，致病菌以金黄色葡萄球菌、表皮葡萄球菌（B对）及链球菌为常见。大肠埃希菌（C错）是急性泌尿系感染的常见致病菌。肺炎克雷伯杆菌（D错）是医院获得性肺炎的常见致病菌，也可引起继发性肺脓肿。厌氧菌（E错）是吸入性肺脓肿的常见致病菌。粪链球菌（A错）是人体肠道内的主要菌群之一，不会引起血源性肺脓肿。